女，35岁。G₂P₁，停经70天，下腹隐痛，阴道不规则流血6天，子宫达脐水平，尿hCG（+）。首选的辅助检查
A. 盆腔CT
B. B超检查
C. 血hCG
D. 诊断刮宫
E. PPD试验

正确答案：B。B超检查

解析：育龄期女性，G2P1（孕2产1），停经70天（10周），下腹隐痛，阴道不规则流血6天（停经8～12周左右开始不规则阴道流血，为葡萄胎的最常见症状），子宫达脐水平，尿HCG（+）。正常妊娠20周末子宫底高度位于脐下1横指，妊娠24周末子宫底高度位于脐上1横指，而该患者停经10周子宫达脐水平，提示子宫异常增大。约半数以上葡萄胎患者的子宫大于停经月份，并伴HCG水平异常升高。综合以上因素，应考虑诊断为葡萄胎。B超检查（B对）是诊断葡萄胎的首选辅助检查，通常采用经阴道彩色多普勒超声，可直接进行观察。典型的超声图像为子宫大于相应孕周，无妊娠囊或胎心搏动，宫腔内充满不匀质密集状或短条状回声，呈“落雪状”，水泡较大时呈“蜂窝状”。血HCG（C错）测定是诊断葡萄胎的另一项重要的辅助检查，葡萄胎时血HCG滴度常明显高于正常孕周，而且在停经8～10周后继续持续上升，＞8万U/L支持诊断，但也有少数葡萄胎因绒毛退行性变，血HCG升高不明显，故不如B超检查直接准确；盆腔CT（A错）检查费用昂贵且观察不直接；诊断刮宫（D错）是最终的诊断依据，也是葡萄胎的治疗方法，但其有创性，均不是首选的辅助检查。PPD试验（结核菌素试验）（E错）是结核杆菌感染的辅助检查。